通过筛检高血压预防脑卒中属于
A. 整群筛检
B. 多项筛检
C. 选择性筛检
D. 预防性筛检
E. 治疗性筛检

正确答案：D。预防性筛检